药物固体分散体的类型不包括
A. 固态溶液
B. 低共熔混合物
C. 高分子聚合物
D. 共沉淀物
E. 玻璃液态物

正确答案：C。高分子聚合物

解析：本题考查的是药物固体分散体的类型。高分子聚合物常为固体分散体的载体（C错，为本题正确答案）。按药物的分散状态固体分散体可分为：①低共熔混合物（B对）。药物以微晶形式分散于载体中成为物理混合物。②固态溶液（A对）。药物以分子状态溶解在固体载体中形成均相体系。固态溶液中药物的分散度往往比低共熔混合物中的更高，因此，其溶出速度较快。③玻璃溶液或玻璃混悬液（E对）。药物溶于熔融的透明状的无定形载体中，骤然冷却，得到质脆透明状态的固体溶液或混悬液。④共沉淀物（D对）。固体药物与载体以适当比例形成的非结晶性无定形物。药物在固体分散体中的分散状态不一定以上述某一种方式单独存在，往往是多种类型的混合体。高分子聚合物为固体分散体的水溶性载体材料。水溶性载体材料：常用的有高分子聚合物（如聚乙二醇类、聚维酮类）、表面活性剂（如泊洛沙姆188、磷脂）、有机酸（如枸橼酸、酒石酸）、糖类（如山梨醇、蔗糖）、脲类（如尿素）等。这类载体材料水溶性大，作为固体分散体的载体材料，可增加难溶性药物溶出速度，提高其生物利用度。